52岁妇女，绝经6年，阴道淋漓流血10天。查右附件区扪及手拳大肿物，阴道脱落细胞提示雌激素高度影响。本例最可能的诊断应是右侧卵巢
A. 纤维瘤
B. 浆液性囊腺瘤
C. 良性囊性畸胎瘤
D. 粘液性囊腺瘤
E. 卵泡膜细胞瘤

正确答案：E。卵泡膜细胞瘤

解析：患者为老年女性，绝经后出现阴道不规则流血，查右附件区扪及手拳大肿物（怀疑妇科肿瘤），阴道脱落细胞提示雌激素高度影响（卵泡膜细胞瘤是有内分泌功能的卵巢实性肿瘤，能分泌雌激素，促使子宫内膜增生，出现阴道不规则流血），最可能的诊断是右侧卵巢卵泡膜细胞瘤（E对）。纤维瘤（P330）（A错）的特点是伴有腹腔积液或胸腔积液，手术切除后，积液自行消失。浆液性囊腺瘤（P326）（B错）多为单侧，表面光滑，囊内充满淡黄色清亮液体；黏液性囊腺瘤（P326）（D错）多为单侧，囊腔内充满胶冻样黏液，含黏蛋白和糖蛋白，均不能分泌雌激素。良性囊性畸胎瘤（P329）（C错），即成熟畸胎瘤，多为单侧，以20～40岁居多，可分泌甲状腺激素，但不能分泌雌激素。